动作电位到达轴突前膜引起递质释放与哪种离子的跨膜移动有关
A. Ca²⁺内流
B. Ca²⁺外流
C. Na⁺内流
D. Na⁺外流
E. K⁺外流

正确答案：A。Ca²⁺内流